促进抗利尿激素ADH分泌的药物是
A. 格列吡嗪
B. 甲苯磺丁脲
C. 二甲双胍
D. 氯磺丙脲
E. 阿卡波糖

正确答案：D。氯磺丙脲

解析：氯磺丙脲和格列本脲能促进抗利尿激素的分泌并增强其作用，减少水的排泄（D对）。